负责制订公共场所卫生标准和要求的部门是
A. 国务院卫生行政部门
B. 省级卫生行政部门
C. 国务院质量技术监督部门
D. 省级质量技术监督部门
E. 省级环境保护部门

正确答案：A。国务院卫生行政部门

解析：本题考查制订公共场所卫生标准和要求的部门。国务院卫生行政部门（A对BCDE错）是中国政府最高级别的卫生行政部门，负责制订全国性的卫生政策和标准，包括公共场所卫生标准和要求，以保障公众的健康和安全。